皮瓣移植后首先恢复的感觉是
A. 冷
B. 热
C. 痒
D. 痛
E. 以上都是

正确答案：D。痛

解析：无论哪种皮瓣移植后，皮肤的感觉在短期内都是缺失的。感觉的恢复首先为痛觉，最后是温度觉。掌握“皮片移植”知识点。